翼外肌功能亢进、翼外肌痉挛属于
A. 咀嚼肌紊乱疾病类
B. 关节结构紊乱疾病类
C. 炎性疾病类
D. 骨关节疾病类
E. 骨关节炎

正确答案：A。咀嚼肌紊乱疾病类

解析：咀嚼肌紊乱疾病类主要为咀嚼肌的功能不协调、功能亢进和痉挛等。常见类型包括翼外肌功能亢进、翼外肌痉挛、咀嚼肌群痉挛和肌筋膜痛。掌握“颞下颌关节紊乱”知识点。